关于生殖道感染说法错误的是
A. 主要由性行为传播
B. 可以是内源性感染
C. 可以由衣原体引起
D. 只发生在女性
E. 宫颈炎属于此类疾病

正确答案：D。只发生在女性

解析：本题考查生殖道感染的相关内容。生殖道感染男女性都可以发生（D错，为本题正确答案）。生殖健康主要由性行为传播（A对），它不仅可以是内源性感染（B对），也可以由衣原体引起（C对），生殖健康的影响较大，常见的不良结局有盆腔炎、宫颈炎（E对）、女性不孕、异位妊娠以及流产、死胎等，严重者甚至有致命的后果，如宫颈癌和艾滋病。